男性，15岁。诉左上颌后牙进食时疼痛明显1周。无自发痛。口腔检查：左上4远中邻面深龋，探酸痛，温度刺激酸痛更明显，刺激去除后疼痛即刻消失。X线片示：根尖未完全形成。腐质去尽备洞时穿髓，恰当的治疗方法是
A. 干髓术
B. 牙髓切断术
C. 直接盖髓术
D. 间接盖髓术
E. 根管治疗

正确答案：C。直接盖髓术

解析：本题考查直接盖髓术的适应证。男性，15岁。诉左上颌后牙进食时疼痛明显1周。无自发痛。口腔检查：左上4远中邻面深龋，探酸痛，温度刺激酸痛更明显，刺激去除后疼痛即刻消失。X线片示：根尖未完全形成。腐质去尽备洞时穿髓，恰当的治疗方法是直接盖髓术（C对）。该患者15岁，左上4为年轻恒牙，根尖孔尚未完全发育，而直接盖髓术是用药物覆盖牙髓暴露处，以保护牙髓、保存牙髓活力的方法，适用于备洞时的意外露髓，根尖孔尚未发育完全时因机械性或外伤性露髓的年轻恒牙或者是根尖已发育完全，机械性或外伤性露髓，穿髓孔直径不超过0.5mm。对于年轻恒牙来说，应坚持尽可能保存活髓的原则，因而不宜采用干髓术（A错）、根管治疗术（E错）。牙髓切断术是切除炎症牙髓，以盖髓剂覆盖于牙髓断面，保留正常活髓组织的方法，与直接盖髓术相比操作复杂，且对牙髓组织的损害较大，难以确定炎症范围，难以保证真正无菌，成功率不高，因而不宜用牙髓切断术（B错）。间接盖髓术（D错）是将盖髓剂覆盖在接近牙髓的牙本质上，适用于深龋近髓或外伤牙冠折断近髓无明显牙髓炎症症状的患牙，在题干中患牙已穿髓且出现明显症状1周，因而不宜用间接盖髓术。